患者胸腔积液合并剧烈胸痛，最可能的诊断是
A. 胸膜问皮瘤
B. 右心衰竭合并胸水
C. 结核性胸膜炎
D. 肝硬化引起胸水
E. 肺炎合并反应性胸膜炎

正确答案：A。胸膜问皮瘤

解析：患者有胸水，一般胸膜炎引起的胸痛都是在胸水较少时，由于脏、壁两层胸膜摩擦引起的，当出现胸水的时候胸痛会减轻。但本题中胸腔积液合并剧烈胸痛，只有胸膜间皮瘤，由于肿瘤侵袭胸膜，出现持续性胸痛，有胸水也不会减轻（A对）；右心衰竭合并胸水的临床表现主要为体循环淤血，肝脏肿大，胃肠道淤血后的腹胀，饮食差，食欲减退，恶心呕吐等，下肢浮肿，泌尿系统的尿少，夜尿增多等，严重者神经系统也可以出现神经过敏，失眠，嗜睡，精神错乱等表现（B错）；结核性胸膜炎临床症状可有发热、乏力、盗汗、胸痛、刺激性干咳、胸闷、呼吸困难等表现（C错）；肝硬化引起胸水的临床症状主要包括两方面：一方面是肝硬化的症状，包括肝功能减退和门静脉高压的症状；另外一方面，是胸腔积液的症状，胸腔积液的症状主要跟胸水量的多少有关系，少量胸水常常没有明显症状，随着胸水压的增加，可以出现不同程度的呼吸困难，可以伴有咳嗽，伴有胸痛（D错）；肺炎合并反应性胸膜炎的临床症状，一般患者会出现有发热、咳嗽、胸闷、胸痛、气急以及呼吸困难等症状（E错）。